生长因子受体不具备下列哪项结构特点
A. 是跨膜糖蛋白
B. 胞外部分构成结合域
C. 跨膜段由20多个疏水氨基酸组成
D. 胞内部分有较多可以被磷酸化的酪氨酸残基
E. 酪氨酸残基磷酸化后形成与G蛋白的结合位点

正确答案：E。酪氨酸残基磷酸化后形成与G蛋白的结合位点